水的重吸收量不多但可被调节的部位是
A. 近端小管
B. 髓袢降支细段
C. 髓袢升支细段
D. 髓拌升支粗段
E. 远曲小管和集合管

正确答案：E。远曲小管和集合管